以下哪项的内容符合以人群健康为目的，强调环境与人群的相互依赖、相互作用和协调发展。
A. 预防医学
B. 医学心理学
C. 医学伦理学
D. 临床外科学
E. 传染病学

正确答案：A。预防医学

解析：预防医学是医学的一门应用学科，它以人群健康为目的，强调环境与人群的相互依赖、相互作用和协调发展。掌握“预防医学概论、健康及三级预防策略”知识点。